治疗习惯性流产脾肾两虚，首选
A. 泰山磐石散
B. 补肾固冲丸
C. 胎元饮
D. 寿胎丸
E. 十全大补丸

正确答案：B。补肾固冲丸

解析：习惯性流产之脾肾两虚证归为肾气亏损型，治法宜补肾益气，调固冲任，方药首选补肾固冲丸（B对）。习惯性流产之气血虚弱型，治宜益气养血，调固冲任，方选泰山磐石散（A错）。先兆流产之气血虚弱证，治宜补气养血，固肾安胎，方选胎元饮（C错）。先兆流产之肾虚证，治宜固肾益气，固冲安胎，方选寿胎丸（D错）。十全大补丸为气血双补剂，用于气血两虚证（E错）。